毛果芸香碱（匹鲁卡品）对眼的作用表现为
A. 降低眼内压、缩瞳、调节痉挛
B. 降低眼内压、扩瞳、调节麻痹
C. 降低眼内压、扩瞳、调节痉挛
D. 升高眼内压、扩瞳、调节痉挛
E. 升高眼内压、扩瞳、调节痉挛

正确答案：A。降低眼内压、缩瞳、调节痉挛

解析：毛果芸香碱（匹鲁卡品）为M受体激动剂，可直接激动虹膜瞳孔括约肌（受动眼神经的副交感纤维即胆碱能纤维调节）引起缩瞳（BCDE错）；缩瞳可使虹膜向中心拉动，虹膜根部变薄，使虹膜前房角间隙扩大，房水易于经滤帘进入巩膜静脉窦，使眼内压下降（DE错）；毛果芸香碱使环状肌收缩，造成悬韧带放松，晶状体由于其自身弹性变凸，屈光度增加，此时只适合视近物，而难以看清远物即调节痉挛作用（B错）（P55），故对眼的作用表现为降低眼内压、缩瞳、调节痉挛（A对）。